患者，女，43岁。近3个月来午后低热，剧烈咳嗽，痰中带血，进食少，乏力，消瘦；查体：双肺呼吸音稍粗，未闻及干湿性音及胸膜摩擦音；应用“头孢氨苄琥乙红霉素”无明显疗效，拍胸部X线片检查示：右肺下叶背段见不规则斑片状阴影，其内可见空腔，血沉未见增快，结核分枝杆菌培养阳性。首先考虑诊断为
A. 肺炎
B. 肺癌
C. 肺脓肿
D. 肺结核
E. 支气管哮喘

正确答案：D。肺结核

解析：结核病是由结核分枝杆菌引起的慢性感染性疾病，其中引起肺部感染者称为肺结核，是临床最为常见的结核病。结核分枝杆菌还可侵袭浆膜腔、淋巴结、泌尿生殖系统、肠道、肝脏、皮肤、骨骼及关节等多种脏器和组织，引起其他结核病。肺结核多呈慢性过程，以低热、盗汗、消瘦、乏力、食欲不振等全身中毒症状及咳嗽、咳痰、咯血、呼吸困难、胸痛等呼吸系统症状为主要表现（D对）。肺炎是由病原微生物（如细菌、病毒、真菌、支原体、衣原体、立克次体、寄生虫等）或其他因素（如放射线、化学损伤、免疫损伤、过敏及药物等）引起的终末气道、肺泡腔及肺间质的炎症。其中细菌性肺炎是最常见的肺炎，也是最常见的感染性疾病之一。临床表现为寒战、高热、咳嗽、咯痰、胸痛、呼吸困难等（A错）。肺癌的临床表现比较复杂，症状和体征的有无、轻重以及出现的早晚，取决于肿瘤发生部位、病理类型、有无转移及有无并发症，以及患者的反应程度和耐受性的差异。肺癌早期症状常较轻微，甚至可无任何不适。中央型肺癌症状出现早且重，周围型肺癌症状出现晚且较轻，甚至无症状，常在体检时被发现。肺癌的症状大致分为：局部症状、全身症状、肺外症状、浸润和转移症状（B错）。肺脓肿是肺组织坏死形成的脓腔，它是由多种病原菌引起的肺部化脓性感染性疾病。早期为肺组织的感染性炎症，继而坏死、液化，由肉芽组织包裹形成脓肿。临床以高热、咳嗽、略大量脓臭痰为特征（C错）。哮喘，是种多因素的异质性疾病，常以慢性气道炎症为特征；既往有喘息、气短、胸闷和咳嗽等呼吸道症状并随时间和强度改变，并伴有可逆性气流受限（E错）。